肛门肿物，排便时反复突出，可自行回纳，下列分级正确的是
A. 1级
B. 2级
C. 3级
D. 4级
E. 5级

正确答案：B。2级

解析：患者肛门肿物，排便时反复突出（均内痔的主要临床表现），可自行回纳（便后自行回纳符合内痔分度2级），根据患者的临床表现可判断为2级（B对ACDE错）。内痔的分度：Ⅰ度：便时带血、滴血或手纸带血，便后出血可自行停止，无痔脱出；Ⅱ度：排便时有痔脱出，便后可自行还纳，可伴出血；Ⅲ度：排便或久站、咳嗽、劳累、负重时痔脱出肛门外，需用手辅助还纳，可伴出血；Ⅳ度：痔脱出不能还纳或还纳后又脱出，可伴出血。